红外分光光度法在药物杂质检查中主要用来检查
A. 合成反应中间体
B. 无紫外吸收的杂质
C. 具有挥发性的杂质
D. 金属的氧化物或盐
E. 无效或低效的晶型

正确答案：E。无效或低效的晶型